属于肿瘤的囊肿是
A. 前庭大腺囊肿
B. 宫颈腺囊肿
C. 卵巢巧克力囊肿
D. 输卵管卵巢囊肿
E. 卵巢皮样囊肿

正确答案：E。卵巢皮样囊肿

解析：卵巢皮样囊肿又称卵巢成熟畸胎瘤，属于良性肿瘤（E对）。前庭大腺囊肿（A错）是因前庭大腺腺管开口部阻塞，分泌物积聚于腺腔而形成的；宫颈腺囊肿（B错）是因新生的鳞状上皮覆盖子宫颈腺管口或伸入腺管，将腺管口阻塞，导致腺体分泌物引流受阻，潴留形成囊肿；卵巢巧克力囊肿（C错）是因异位内膜侵犯卵巢皮质并在其内生长、反复周期性出血，形成单个或多个囊肿，也称卵巢子宫内膜异位囊肿。输卵管卵巢囊肿（D错）属于盆腔炎性疾病后遗症，是因输卵管伞端闭锁，浆液性渗出物聚集形成的囊肿。